下列关于川崎病的预后错误的是
A. 为自限性疾病，多数预后良好
B. 少数患儿可见复发
C. 未经有效治疗的患儿，并发冠状动脉损害者可达50%～60%
D. 病死率约0.5%
E. 死因为心肌梗死或冠状动脉瘤破裂致心源性休克，甚至猝死

正确答案：C。未经有效治疗的患儿，并发冠状动脉损害者可达50%～60%

解析：川崎病为自限性疾病，多数预后良好；1%～2%的患儿可见复发。未经有效治疗的患儿，并发冠状动脉损害者可达15%～25%；病死率约0.5%，死因为心肌梗死或冠状动脉瘤破裂致心源性休克，甚至猝死。掌握“川崎病”知识点。